下颈段脊髓节段比相应椎骨高
A. 1个椎体
B. 2个椎体
C. 3个椎体
D. 4个椎体
E. 5个椎体

正确答案：A。1个椎体

解析：不同脊髓节段与椎骨的位置对应关系为：上颈髓节段（Cl-C4）与同序数椎骨大致平齐；下颈髓节段（C5-C8）和上胸髓节段（Tl-T4）比相应椎骨高约1个椎体（A对）；中胸髓节段(T5-T8）比相应椎骨高约2个椎体（B错）；下胸髓节段（T9-T12）比相应椎骨高约3个椎体（C错）；腰髓节段约平对第10-12胸椎；骶髓、尾髓节段约平对第1腰椎。